热休克的患者不会有的症状是
A. 神志清醒
B. 皮肤湿冷
C. 尿量大于30ml/h
D. 脉压大于30mmHg
E. 皮肤色泽淡红

正确答案：B。皮肤湿冷

解析：暖休克又称高动力型休克，指病原体或其毒素侵入机体后，引起高代谢和高动力循环状态，患者的皮肤温热而干燥，不会出现湿冷的症状（B错，为本题正确答案）。